想象属心理现象中的
A. 认识过程
B. 情感过程
C. 意志过程
D. 人格特征
E. 情绪过程

正确答案：A。认识过程

解析：心理现象分为两大类，分别是心理过程和个性特征。心理过程包括认识过程、情感过程、意志过程；个性特征包括人格倾向性、人格特症和自我意识系统。其中，认识过程（A对）又包括了感觉、知觉、记忆、思维和想象等；情感、情绪过程（P21）（BE错）包括喜怒哀乐等；意志过程（P27）（C错）是指有意识的确定目标、克服困难和支配自身的行动等。人格特征（P29）（D错）包括能力、气质、性格。